西红花的性状鉴别特征有
A. 药材呈线形，三分枝，表面暗红色
B. 柱头顶端边缘显不整齐的齿状，内侧有一条短缝
C. 体重，有绢丝样光泽
D. 气特异，微有刺激性，味微苦
E. 浸水中，水被染成红色，有沉淀。

正确答案：A、B、D。药材呈线形，三分枝，表面暗红色；柱头顶端边缘显不整齐的齿状，内侧有一条短缝；气特异，微有刺激性，味微苦

解析：本题考查的是西红花药材的性状鉴别。西红花的性状鉴别特征有药材呈线形，三分枝，表面暗红色（A对）、柱头顶端边缘显不整齐的齿状，内侧有一条短缝（B对）与气特异，微有刺激性，味微苦（D对）。西红花：【性状鉴别】药材呈线形，三分枝。暗红色，上部较宽而略扁平，顶端边缘显不整齐的齿状，内侧有一短裂隙，下端有时残留一小段黄色花柱。体轻，质松软，无油润光泽（C错）。干燥后质脆易断。气特异，微有刺激性，味微苦。取本品浸于水中，可见橙黄色呈直线下降，并逐渐扩散，水被染成黄色，无沉淀（E错）。柱头呈喇叭状，有短缝；在短时间内，用针拨之不破碎。